结肠癌病灶穿透肠壁，无淋巴结转移的是
A. DukesA₁期
B. DukesA₂期
C. DukesB期
D. DukesC期
E. DukesD期

正确答案：C。DukesB期

解析：结肠癌Dukes分期标准如下：（1）Dukes A期，癌肿限于肠壁内；（2）Dukes B期，癌直接浸润到直肠或结肠组织外，无淋巴结转移；（3）Dukes C期，局部淋巴结转移；（4）Dukes D期，腹膜或网膜转移、转移超过外科切除范围。患者结肠癌病灶穿透肠壁，无淋巴结转移，属于Dukes B期（C对）。